位于多根牙的根分叉之间，防止牙根向冠方移动的是
A. 牙槽嵴组
B. 水平组
C. 斜行组
D. 根间组
E. 根尖组

正确答案：D。根间组

解析：根间组：只存在于多根牙，起自根分叉处的牙根间骨隔顶，止于根分叉区牙骨质，有防止牙根向冠方移动的作用。掌握“牙周膜”知识点。